下列各项中，属于母病及子的是
A. 肺病及肾
B. 肝病及肾
C. 肺病及心
D. 心病及肝
E. 脾病及肾

正确答案：A。肺病及肾

解析：肺属金，肾属水，金生水，金为水之母，所以肺病及肾属于母病及子（A对），肝属木，肾属水，水生木，所以肝病及肾属于子病及母（B错），肺属金，心属火，火克金，肺病及心不属于母与子的关系范围（C错），心属火，肝属木，木生火，心病及肝属于子病及母（D错），脾属土，肾属水，土克水，脾病及肾不属于母与子之间的关系（E错）。